关于头面部的痛、温觉和触觉传导通路的描述，错误的是
A. 第三级纤维投射到中央后回上部
B. 第一级神经元位于三叉神经节
C. 三叉神经脊束核和脑桥核发出的纤维越边到对侧形成三叉丘系
D. 第三级纤维终止于同侧背侧丘脑腹后内侧核
E. 以上都不是

正确答案：A。第三级纤维投射到中央后回上部

解析：头面部的痛温觉和触压觉传导通路的第一级神经元为三叉神经节内假单极神经元（B对）。第2级神经元的胞体在三叉神经脊束核和三叉神经脑桥核，它们发出的纤维交叉到对侧（C对）。第3级神经元的胞体经内囊后脚终于背侧丘脑的腹后内侧核（D对A错，为本题正确选项）。